牙一般在牙根形成多少时才开始萌出
A. 1/4左右
B. 1/3左右
C. 1/2左右
D. 2/3左右
E. 全部形成

正确答案：D。2/3左右

解析：本题考查年轻恒牙的特点。恒牙一般在牙根形成2/3左右（D对）时开始萌出，萌出后的牙根继续发育，于萌出后2-3年牙根达到应有长度。有时由于乳牙早失，恒牙牙根形成未达2/3时，如1/4（A错）、1/3（B错）和1/2（C错），即开始萌出，可导致恒牙牙根长度发育不足，根尖孔过早闭合，易致牙松动。牙齿埋伏阻生时，牙根全部形成（E错），需在牵引及手术情况下，才可萌出。